后牙邻面龋的形状特征是
A. 釉质与牙本质龋均系圆锥形，锥底在最深处
B. 釉质龋锥尖在最深处，牙本质龋锥底在最深处
C. 釉质龋锥尖与牙本质龋锥尖相联接
D. 釉质龋锥尖与牙本质龋锥底相联接

正确答案：D。釉质龋锥尖与牙本质龋锥底相联接

解析：本题考查釉质龋与牙本质龋。后牙邻面龋的形状特征是釉质龋锥尖与牙本质龋锥底相联接（D对）。后牙邻面龋属于平滑面龋。釉质龋龋损呈三角形（A错），顶向着釉牙本质界，基底部向着釉质表面；牙本质龋的三角形龋损，顶指向牙髓腔（B错），底指向釉牙本质界。釉质龋锥尖与牙本质龋锥底在釉牙本质界处相联接（D对C错）。